25岁就诊患者，口腔卫生情况不佳，左下第一恒磨牙患者有牙髓-牙周联合病变，疼痛剧烈，但患牙无松动。为了消除病痛，恢复健康首先采取的措施开髓引流，阻止炎症扩展。上述治疗措施属于三级预防。同时还应对其采取
A. 左下第一恒磨牙脱敏
B. 左下第一恒磨牙充填
C. 左下第一恒磨牙牙周治疗
D. 左下第一恒磨牙调牙合
E. 左下第一恒磨牙拔除

正确答案：C。左下第一恒磨牙牙周治疗

解析：本题考查牙髓-牙周联合病变的治疗原则。患者口腔卫生情况不佳，且有牙周-牙髓联合病变，应找出原发病变，消除其感染源，故应在根管治疗开始后，同时或尽快开始牙周治疗（C对），才能消除袋内的感染，促使组织愈合，否则效果不佳。脱敏（A错）多用于治疗牙本质敏感症，而不是牙髓病。充填术（B错）多用于龋病或牙本质敏感，而不是牙髓牙周病。调（牙合）（D错）是去除咬合干扰及（牙合）早接触，不可用于牙髓-牙周联合病变的治疗。若牙体组织龋坏或破坏严重、松动度严重、用现有的修复手段已无法恢复和利用者或根尖周病不能用根管治疗、根尖切除等方法治愈者方可拔除（E错），患牙松动度不大，尚有保留价值，故不可拔除。